按桥体龈面的形态及其与牙槽嵴顶的接触部分而分类不包括
A. 盖嵴式桥体
B. 改良盖嵴式桥体
C. 船底式桥体
D. 鞍式桥体
E. 悬空式桥体

正确答案：E。悬空式桥体

解析：按照桥体龈面的形态及其与牙槽嵴顶的接触部位而分为以下几种形式：盖嵴式桥体、改良盖嵴式桥体、鞍式桥体、改良鞍式桥体、船底式桥体。按桥体龈端与牙槽嵴黏膜接触关系分类：接触式桥体和悬空式桥体。掌握“固定桥的设计”知识点。